慢阻肺描述错误的是
A. 呈进行比发展
B. 尚不可治疗
C. 高致残率
D. 高发病率
E. 高死亡率

正确答案：B。尚不可治疗

解析：慢性阻塞性肺疾病（简称慢阻肺或COPD），COPD是一种具有不完全可逆气流受限为特征的肺部疾病，呈进行比发展，主要表现为加速下降的肺功能。虽然COPD是一种高发病率、高死亡率、高致残率的疾病。但是，COPD仍然是可以预防和可以治疗的疾病。掌握“慢性阻塞性肺疾病”知识点。